气短乏力，兼见月经量多，其病机是
A. 气血两虚
B. 气血失和
C. 气滞血瘀
D. 气不摄血
E. 气随血脱

正确答案：D。气不摄血

解析：气血两虚月经量少（A错）。气血失和为气血不相调和，概念叫为宽泛，题中选项均属气血失和（B错）。气滞血瘀多有胀痛，月经有血块（C错）。气不摄血为出血与气虚的症状并见，气短乏力为气虚的表现，气虚冲任不固，血失统摄，故月经量多，故其病机为气不摄血的病机（D对）。气随血脱病情较重，多有冷汗淋漓，气少息微的症状，较气短乏力严重的多（E错）。